既属本经络穴，又属八脉交会穴的腧穴
A. 太渊
B. 丰隆
C. 列缺
D. 足临泣
E. 偏历

正确答案：C。列缺

解析：列缺既为手太阴肺经的络穴又为八脉交会穴（C对）。太渊为手太阴肺经的原穴（A错）；丰隆是足阳明胃经的络穴（B错）；足临泣仅为八脉交会穴（D错）；偏历为手阳明大肠经的络穴（E错）。